患者，女，40岁。不明原因出现手足发麻，关节肿痛半年余。开始为手指小关节疼痛，后出现其他关节疼痛，呈对称性，遇寒或晨起时关节发硬，活动后减轻，舌苔薄白，脉浮紧。其最有意义的检查是
A. 血沉
B. 抗核抗体
C. 双手X线平片
D. 抗链球菌溶血素"O"
E. 肾功能

正确答案：C。双手X线平片

解析：根据题干信息，本例患者出现对称性关节痛、晨僵等症状，考虑为类风湿性关节炎，双手X线平片（C对）可早期发现类风湿性关节炎的早期变化。血沉（A错）是炎性标志物，其升高提示疾病处于活动期，特异性不高。RA新的抗体不断被发现，其中有些抗体诊断的特异性较RF明显提高，且可在疾病早期出现，如CCP抗体。而抗核抗体（ANA）（B错）主要是SLE产生的自身抗体，在RA患者中阳性率较低。抗链球菌溶血素“O”（D错）只能提示患者近期感染或既往感染过溶血性链球菌，对RA诊断无显著意义。肾功能（E错）主要排除有无高尿酸血症引起的痛风或有无肾性骨病等，与本题疾病特征不符。